结构中有吡咯烷酮，口服吸收迅速，生物利用度达80%的药物是
A. 奥沙西泮
B. 三唑仑
C. 唑吡坦
D. 艾司佐匹克隆
E. 扎来普隆

正确答案：D。艾司佐匹克隆

解析：本题考查环吡咯酮类镇静催眠药。艾司佐匹克隆（D对）有吡咯烷酮结构，口服后迅速吸收，生物利用度约80%；奥沙西泮（A错）为苯二氮䓬类；三唑仑（B错）含甲基三唑杂环；唑吡坦（C错）含有咪唑并吡定杂环；扎来普隆（E错）含有吡唑并嘧啶杂环，以上四种均不具有吡咯烷酮的结构。